正确描述界嵴的是
A. 是心房和心室的分界
B. 是左心室流入道与流出道的分界
C. 是右心室流入道与流出道的分界
D. 是腔静脉窦和固有心房的分界
E. 为卵圆窝前上方的嵴

正确答案：D。是腔静脉窦和固有心房的分界

解析：左心室流入道与流出道的分界（B错）为二尖瓣前尖。右心室流入道与流出道的分界（C错）为室上嵴。腔静脉窦和固有心房的分界（D对）为界嵴。